药用部位为地上部分的是
A. 紫花地丁
B. 麻黄
C. 穿心莲
D. 通草
E. 槲寄生

正确答案：C。穿心莲

解析：本题考查的是全草类中药的药用部位。药用部位为地上部分的是穿心莲（C对）。药用部位为草本植物新鲜或干燥的全体或地上部分，这类中药称为全草类中药。有的药用部位为草本植物全体，如紫花地丁（A错）、蒲公英、金钱草、半枝莲、车前草等；有的药用部位为草本植物地上部分，如益母草、广金钱草、广藿香、薄荷、穿心莲、香薷、茵陈、青蒿、大蓟等；有的药用部位为草本植物肉质茎或带鳞叶的肉质茎，如锁阳、肉苁蓉等；有的药用部位为草本植物草质茎，如麻黄（B错）；有的药用部位为草本植物茎叶，如淡竹叶。通草（D错）与槲寄生（E错）为茎类中药。茎类中药：药用为植物的茎藤、茎枝、茎刺或茎的髓部，这类中药称“茎类中药”。药用为木本植物藤茎的，如川木通、大血藤、鸡血藤等；药用为带叶茎枝的，如桑寄生、槲寄生；药用为嫩枝的，如桂枝、桑枝等；药用为棘刺的，如皂角刺；药用为茎翅状附着物的，如鬼箭羽；药用为茎髓的，如通草）、灯心草；药用为新鲜或干燥茎的，如石斛等。